对心力衰竭病人进行择期手术，至少待心衰控制以后
A. ＜1周
B. 1～2周
C. 3～4周
D. 5～6周
E. ＞6周

正确答案：C。3～4周

解析：对心力衰竭病人进行择期手术，至少待心衰控制以后3～4周（C对），以降低手术风险和手术并发症（第二版八年制外科学P28）。